功能性活动保持器的适应证为
A. 第二乳磨牙早失.第一恒磨牙萌出不足
B. 第一乳磨牙早失
C. 乳磨牙缺失2个以上或两侧乳磨牙缺失或伴有乳前牙缺失
D. 两侧都存在第二乳磨牙或第一恒磨牙，近期内继承恒牙即将萌出
E. 因龋齿或乳牙早失使间隙变小或消失

正确答案：C。乳磨牙缺失2个以上或两侧乳磨牙缺失或伴有乳前牙缺失

解析：本题考查功能性活动保持器的适应证。功能性活动保持器又称为可摘式间隙保持器，适用于乳磨牙缺失2个以上或两侧乳磨牙缺失或伴有乳前牙缺失（C对），它相当于局部义齿，不仅能保持缺牙间隙的近远中长度，还能保持垂直高度、恢复咀嚼功能，同时恢复因前牙缺失造成的上唇凹陷和语言功能，改进克服不良习惯。第二乳磨牙早失、第一恒磨牙萌出不足（A错）使用远中导板式间隙保持器。第一乳磨牙早失（B错）使用带环（或全冠）丝圈式间隙保持器。两侧都存在第二乳磨牙或第一恒磨牙，近期内继承恒牙即将萌出（D错）使用舌弓式间隙保持器。因龋齿或乳牙早失使间隙变小或消失（E错）使用充填式间隙保持器。